舌咽神经何者错误？
A. 颈动脉窦支传导动脉压及血中二氧化碳浓度的变化
B. 与迷走、副神经一同在橄榄后沟连于脑
C. 与迷走、副神经同经颈静脉孔出颅
D. 支配茎突咽肌的运动
E. 传导舌前2/3的味觉

正确答案：E。传导舌前2/3的味觉

解析：舌咽神经连于延髓橄榄后沟上部，与迷走神经、副神经同穿颈静脉孔前部出入颅腔（BC对），颈静脉孔内神经干上有膨大的上神经节,孔外有稍大的下神经节。经颈静脉孔出颅腔后，于颈内动、静脉之间下行，然后呈弓形向前绕茎突咽肌外侧，至舌骨舌肌深面达舌根，支配茎突咽肌的运动（D对）以及传导舌后1/3的味觉（E错，为本题正确选项）。